既利水通淋，又清解暑热的药是
A. 滑石
B. 木通
C. 金钱草
D. 车前子
E. 地肤子

正确答案：A。滑石

解析：本题考查的是滑石的功效。既利水通淋，又清解暑热的药是滑石（A对）。滑石：【功效】利尿通淋，清解暑热；外用清热收湿敛疮。木通（B错）：【功效】利水通淋，泄热，通经下乳。金钱草（C错）：【功效】利水通淋，除湿退黄，解毒消肿。车前子（D错）：【功效】利水通淋，渗湿止泻，明目，清肺化痰。地肤子（E错）：【功效】利尿通淋，祛风止痒。